不能激活补体经典途径，但其凝聚物可激活补体旁路途径的是
A. IgG1
B. IgG2
C. IgG3
D. IgG4
E. IgM

正确答案：D。IgG4

解析：激活补体：IgG1～3和IgM与相应抗原结合后可发生构型改变而暴露其CH2/CH3功能区内的补体结合点，激活补体经典途径。IgG4、IgA和IgE不能激活补体经典途径，但其凝聚物可激活补体旁路途径。掌握“免疫球蛋白的类型及功能”知识点。